如果漏斗图呈明显的不对称，说明meta分析
A. 统计学检验效能不够
B. 各个独立研究的同质性差
C. 合并效应值没有统计学意义
D. 可能存在偏倚
E. 结果更不可靠

正确答案：D。可能存在偏倚

解析：本题考查漏斗图不对称的原因。如果漏斗图呈明显的不对称，说明meta分析可能存在发表偏倚（D对ABCE错），也可能因为纳入的试验总体质量较差、样本量较小、试验数较少（机遇的作用）、或干预措施的变异性过大。